只供外用不能内服
A. 升药
B. 铅丹
C. 硼砂
D. 硫磺
E. 蛇床子

正确答案：A。升药

解析：升药的外用适量。本品只供外用，不能内服 （A对）。铅丹外用适量，研末撒布或熬膏贴敷。内服每次0.3—0.6g，入丸散服（B错）。硼砂外用适量，研极细末干撒或调敷患处；或化水含漱。内服，1.5-3g，入丸、散用（C错）。硫磺外用适量，研末服或加油调敷患处，内服1.5-3g，炮制后入丸散服，硫磺即可外用也可内服（D错）蛇床子外用适量，多煎汤熏洗或研末调敷（E错）。